被评价者的实际年龄42岁，评价年龄48岁，增长年龄47岁，此被评者属于
A. 健康型
B. 自创性危险因素型
C. 一般性危险型
D. 难以改变的危险因素型
E. 少量危险型

正确答案：D。难以改变的危险因素型